检查某班15岁学生50名，其中患病者10人，龋失补牙数为：D=70，M=2，F=8，龋失补牙面数为D=210，M=10，F=15，这班学生龋面均为
A. 0.8
B. 1.4
C. 1.6
D. 4.2
E. 4.7

正确答案：E。4.7

解析：龋均和龋面均　龋均（DMFT）指受检查人群中每人口腔中平均龋、失、补牙数。龋面均（DMFS）指受检查人群中每人口腔中平均龋、失、补牙面数。掌握“龋病流行病学”知识点。